下列有关现况研究优点的描述正确的是
A. 可以检验疾病的病因
B. 调查时可以同时测量多种因素
C. 抽样调查时样本数量都比较小
D. 不存在生存者偏倚
E. 调查偏倚较少

正确答案：B。调查时可以同时测量多种因素

解析：本题考查现况研究的优点。现况研究是通过对特定时点（或期间）和特定范围内人群中的疾病或健康状况和有关因素的分布状况的资料收集、描述，从而为进一步的研究提供病因线索。其优点是调查时可以同时测量多种因素（B对ACDE错）。